晚期产后出血气虚证的治疗方剂为
A. 补中益气汤
B. 生化汤合失笑散
C. 保阴煎
D. 五味消毒饮合失笑散
E. 归脾汤

正确答案：A。补中益气汤

解析：晚期产后出血气虚证的病因病机是孕母素体气虚，复因产时失血耗气；或产后操劳过早，损伤脾气，气虚冲任不固，血失统摄。治宜补脾益气，固冲摄血，选用补中升阳的补中益气汤加补血固摄安胎的艾叶炭、鹿角胶（A对）。保阴煎（C错）主治晚期产后出血的血热证；生化汤合失笑散（B错）主治晚期产后出血的血瘀证；归脾汤（E错）主治脾不统血之崩漏；五味消毒饮合失笑散（D错）主治晚期产后出血感染邪毒证。